女，73岁。蛋白尿2个月，尿蛋白7g/d，蛋白电泳显示以小分子蛋白为主，呈单株峰。其蛋白尿的性质应该为
A. 肾小管性蛋白尿
B. 肾小球性蛋白尿
C. 分泌性蛋白尿
D. 组织性蛋白尿
E. 溢出性蛋白尿

正确答案：E。溢出性蛋白尿

解析：蛋白电泳是一种蛋白质的分析技术，蛋白质在缓冲液中带负电荷或正电荷，在电场中向阳极移动称为电泳，不同的蛋白质分子具有不同的电泳迁移率。蛋白尿呈单株峰，说明尿中只是某一种蛋白升高，符合答案的只有溢出性蛋白尿（E对），由于血中某种异常蛋白质增多，经肾小球滤出，超过肾小管重吸收能力，在尿中出现，其他的蛋白尿一般都不可能是单株峰。